检查激素、药物等微量物质的方法是
A. 免疫荧光法
B. 免疫胶体金技术
C. 对流免疫电泳
D. ELISA
E. 放射免疫测定法

正确答案：E。放射免疫测定法